患者，女，32岁，已婚，有长期避孕需求，排除禁忌证后，放置左炔诺孕酮节育系统。关于左炔诺孕酮宫内节育系统的说法，错误的是
A. 放置该系统后的前3～6个月，可能会出现经量增多、行经期延长
B. 该系统可维持5年有效
C. 放置后如发生下腹痛伴出血，需及时就诊
D. 该系统可抑制精子运输以及卵子受精，并部分抑制排卵
E. 于月经开始的第一天放置

正确答案：E。于月经开始的第一天放置

解析：本题考查宫内节育系统。宫内节育系统：左炔诺孕酮宫内节育系统（LNG-IUD），含左炔诺孕酮52mg，由医生放置于宫腔内，可维持5年有效（B对）。一般在月经周期第3～7天放入（E错，为本题正确答案）。放置后如发生下腹痛见出血，需及时就诊（C对）。体内药物释放速率开始时约为20㎍/24小时，5年后降为约10㎍/24小时。释放左炔诺孕酮的宫内节育系统可抑制精子运输以及卵子受精，并部分抑制排卵（D对），从理论上讲预防着床是另一个可能的避孕机制。在LNG-IUD使用的前3～6个月内，可能会出现较重或更长的月经出血（A对）；通常这种出血是无害的，随着时间的推移变得更轻；如果出血仍然非常严重或延长，特别是有贫血的临床症状，或者女性感觉出血不能接受，可取出LNG-IUD并选择其他方法。